肌肉强直性痉挛是破伤风的典型症状之一，其首先出现的部位是
A. 上肢
B. 下肢
C. 头面
D. 颈项
E. 躯干

正确答案：C。头面

解析：破伤风发作期的典型发作症状为全身或局部性的肌肉强直性痉挛和阵发性抽搐。其肌肉强直性痉挛首选从头面部开始，进而延展至躯干（E错）四肢（AB错），其顺序为咀嚼肌、面肌、颈项肌、背腹肌、四肢肌群、膈肌和肋间肌（C对D错）。